患者，男，11岁，因发热、咳嗽2天就诊，以“肺部感染”收治入院。经验性抗感染治疗3天后，病原体培养+体外药敏试验结果显示肺炎链球菌感染。首选的目标性抗感染药物是
A. 阿奇霉素
B. 克林霉素
C. 莫西沙星
D. 依替米星
E. 阿莫西林

正确答案：E。阿莫西林

解析：本题考查社区获得性肺炎常见病原体目标治疗。①肺炎链球菌（青霉素MIC＜2mg/L）首选青霉素类药物进行治疗。②肺炎链球菌（青霉素MIC≥2mg/L）根据药敏结果选择治疗方案，包括头孢噻肟、头孢曲松、氟喹诺酮类药物（左氧氟沙星或莫西沙星）（C错）、万古霉素、利奈唑胺、高剂量阿莫西林（E对）（3g/d青霉素MIC*≤4mg/L）。该患者年龄属于未成年，禁止使用喹诺酮类药物。